患者女，22岁，既往有胃溃疡史，因焦虑手颤就诊，体征和实验室检查：甲状腺激素（T₃和T₄）水平增高，心率102次/分钟。服用抗甲状腺药丙硫氧嘧啶和卡比马唑两个月后，监测到白细胞和粒细胞计数急剧下降，白细胞计数为3.1×10⁹/L，除停药外，应该考虑选用救治的药品是
A. 利血生
B. 左甲状腺素
C. 维生素B₂
D. 地高辛
E. 黄体酮

正确答案：A。利血生

解析：本题考查利血生。抗甲状腺药丙硫氧嘧啶和卡比马唑可引起白细胞减少症。在用药期间，应每周检查1次白细胞，如白细胞计数＜3x10⁹/L时，一般需停药观察，如白细胞计数在（3～4）x10⁹/L，应每隔1-3日检查1次，并服用促白细胞药利血生（利可君）、鳖甘醇，必要时合用糖皮质激素治疗。本题患者白细胞计数为3.1×10⁹/L，所以除停药外，应该考虑选用救治的药品为利血生（A对）。